银汞合金填充，操作不正确的是
A. 少量多次填充，铺平后厚度小于等于1mm
B. 先用小填充器，层层压紧
C. 再用大填充器，最后于（牙合）面加压
D. 邻（牙合）面洞先填（牙合）面洞，再填邻面洞
E. 银汞合金从调制到填充完毕、雕刻成形应在6～7分钟内

正确答案：D。邻（牙合）面洞先填（牙合）面洞，再填邻面洞

解析：本题考查银汞合金充填术。充填邻（牙合）面洞时，一般先填充邻面洞部分，后填（牙合）面洞（D错，为本题的正确答案）。银汞合金一般用于后牙的修复，具有抗压强度好，耐磨性强等性能。银汞合金充填时采用银汞合金输送器将调制好的银汞合金少量多次填充，铺平后厚度小于等于1mm（A对）。先用小填充器，层层压紧（B对），使汞合金与洞壁密合，再用大填充器，最后于（牙合）面加压（C对），确保洞缘汞合金的强度。银汞合金从调制到填充完毕、雕刻成形应在6～7分钟内（E对）。